属于雄激素受体阻断剂，使增生的前列腺体积缩小的药品
A. 黄酮哌酯
B. 氟他胺
C. 特拉唑嗪
D. 非那雄胺
E. 尼尔雌醇

正确答案：B。氟他胺

解析：本题考查氟他胺的药理作用。氟他胺（B对）为雄激素受体阻断剂，可用于良性前列腺增生的治疗。